患者，女性，28岁，烦渴多尿1年，不规律用胰岛素治疗，食欲缺乏、呕吐3天。体检：体温36.2℃，呼吸深大有异昧。血糖22mmol/L，尿糖（++++），酮体（+++）。最可能的诊断为
A. 急性肠炎+代谢性酸中毒
B. 代谢性碱中毒
C. 乳酸酸中毒
D. 糖尿病酮症酸中毒
E. 非酮症高渗性糖尿病昏迷

正确答案：D。糖尿病酮症酸中毒